《中国药典》2010年版对药物制剂稳定性长期试验温度和湿度的要求是
A. 温度40℃±2℃，相对湿度75%±5%
B. 温度60℃±2℃，相对湿度75%±5%
C. 温度25℃±2℃，相对湿度60%±10%
D. 温度20℃±2℃，相对湿度60%±10%
E. 温度25℃±2℃，相对湿度75%±5%

正确答案：C。温度25℃±2℃，相对湿度60%±10%

解析：本题考查药品稳定性试验指导原则。长期试验是在接近药品的实际贮存条件下进行，其目的是为制订药品的有效期提供依据。市售包装，在温度25℃±2℃、相对湿度60%±10%（C对）的条件（北方气候）下放置12个月，或在温度30℃±2℃、相对湿度65%±5%的条件（南方气候）下放置12个月。每3个月取样一次，按稳定性重点考察项目检测。12个月以后，仍需继续考察，分别于18个月、24个月、36个月取样检测。将结果与0个月比较以确定药品的有效期。温度40℃±2℃，相对湿度75%±5%（A错）是加速试验的实验条件。